患者，女，24岁，已婚。闭经7个月，形体肥胖，胸胁满闷，呕恶痰多，面浮足肿，舌淡苔白腻，脉沉滑。其证候是
A. 肝肾不足
B. 气血虚弱
C. 痰湿阻滞
D. 肝血不足
E. 肺肾阴虚

正确答案：C。痰湿阻滞

解析：患者闭经7个月，属于闭经，脾虚运化失常，不能运化水谷精微，故形体肥胖，脾虚运化失常，聚湿生痰，故呕恶痰多，痰湿停止，聚于胸腕，故胸胁满闷，舌淡苔白腻，脉沉滑均为痰湿凝滞的表现（C对）。肝肾不足，精气未充，天癸匮乏，致月经停闭，腰膝酸软，头晕耳鸣（A错）。气血虚弱，冲任不充，故月经停闭，量少，色淡红，质稀，身疲肢倦，头晕眼花，舌淡苔薄，脉细弱（B错）。肝藏血，肝血不足，则冲任不充，致月经停闭，量少，面色少华，舌淡，脉细（D错）。肺肾阴虚，则出现咳嗽，腰膝酸软，头晕耳鸣（E错）。